根据我国空气污染指数的类别，当易感人群症状轻度加剧，健康人群出现刺激症状时，空气污染指数应该是
A. 0～50
B. 51～100
C. 101～200
D. 201～300
E. ＞300

正确答案：C。101～200